2.5～4岁期间乳牙颌的特征，除外的是
A. 牙排列紧密而无明显间隙
B. 切缘及（牙合）面尚无显著磨耗
C. 乳牙位置较正
D. 覆（牙合）较深，覆盖较小，（牙合）曲线不明显
E. 随着下颌升支发育，暂时性深覆（牙合）减小

正确答案：E。随着下颌升支发育，暂时性深覆（牙合）减小

解析：随着下颌升支发育，暂时性深覆（牙合）减小，是4～6岁期间的特征。掌握“（牙合）的生长发育”知识点。